胸膜叙述错误的是
A. 浆膜
B. 分为脏、壁层
C. 脏、壁层相移行为胸膜腔
D. 脏胸膜突入颈根部形成胸膜顶
E. 壁胸膜的移行处形成胸膜隐窝

正确答案：D。脏胸膜突入颈根部形成胸膜顶

解析：胸膜是一层浆膜（A对）。胸膜分为脏、壁层（B对）。胸膜脏、壁层相移行为胸膜腔（C对）。肋胸膜和纵隔胸膜突入颈根部形成胸膜顶（D错，为本题正确答案）。壁胸膜的移行处形成胸膜隐窝（E对）。